患儿，4岁。2天前出现腹痛，症见脘腹胀满，疼痛拒按，不思乳食，矢气频作，腹痛欲泻，泻后痛减，粪便秽臭，夜卧不安，舌质淡红，苔厚腻，脉象沉滑。其证型是
A. 脾胃虚寒
B. 气滞血瘀
C. 乳食积滞
D. 腹部中寒
E. 胃肠积热

正确答案：C。乳食积滞

解析：本病例以腹痛为主症，故诊断为腹痛。乳食乃有形之物，停滞胃肠，阻塞气机，故见脘腹胀满，疼痛拒按，不思乳食；其气下泄，故见矢气频作；泻则食减邪消，故腹痛欲泻；得泻则乳食积下行，肠胃壅塞暂减，气机稍畅，故泻后痛减；乳食腐化，故粪便秽臭；食停中焦，故见夜卧不安；苔厚腻，脉象沉滑，为乳食停滞之象，故其证型为乳食积滞证（C对）。脾胃虚寒（A错）证临床以起病缓慢，腹痛绵绵，喜温喜按，病程较长，反复发作为特征。气滞血瘀（B错）证临床以痛有定处，痛如锥刺，拒按或腹部癥块为特征。腹部中寒（D错）证临床以腹部疼痛，得温则舒，遇寒痛甚为特征。胃肠积热（E错）证临床以腹部胀满，疼痛拒按，大便秘结为特征。